多发性抽搐症的病因为
A. 脏腑阴阳失调
B. 五志过极，风痰内蕴
C. 元气未充，心神怯弱
D. 肝常有余，肝风内动
E. 脾虚肝旺，肝风扰动

正确答案：B。五志过极，风痰内蕴

解析：该题主要考查多发性抽搐的病因，理解记忆即可。多发性抽搐症的病因病因是多方面的，与先天察赋不足、产伤、窒息、感受外邪、等因素有关，多由五志过极，风痰内蕴而引发（B对）。